下列不利于控制教室眩光的措施是
A. 给教室的照明灯安装灯罩
B. 教室内灯具距课桌面的最低悬挂高度不应低于1.7m
C. 灯管排列采用平行于黑板方向
D. 将教室外的树木移走
E. 增加照明灯具数量

正确答案：C。灯管排列采用平行于黑板方向